关于湿啰音的描述，正确的是
A. 为吸气时气体通过气道内稀薄分泌物形成的水泡破裂声
B. 音调常高带乐音
C. 呼气时易听到
D. 持续时间长
E. 部位易变

正确答案：A。为吸气时气体通过气道内稀薄分泌物形成的水泡破裂声

解析：湿啰音是由于吸气时气体通过呼吸道内的分泌物如渗出液、痰液、血液、黏液和脓液等，形成的水泡破裂所产生的声音（A对）。湿啰音为呼吸音外的附加音，断续而短暂（D错），一次常连续多个出现，于吸气时或吸气终末较为明显（C错），有时也出现于呼气早期，部位较恒定（E错），性质不易变，中小湿啰音可同时存在，咳嗽后可减轻或消失。湿啰音分响亮性和非响亮性，非响亮性湿啰音音调低（B错）。